下列哪项不是β受体阻断药的适应证
A. 高血压
B. 甲状腺功能亢进
C. 窦性心动过速
D. 心绞痛
E. 支气管哮喘

正确答案：E。支气管哮喘